温度在40～70℃具有良好的流动性的材料为
A. 琼脂类
B. 藻酸盐类
C. 聚醚橡胶类
D. A型硅橡胶
E. 缩合型硅橡胶

正确答案：A。琼脂类

解析：琼脂类：室温状态下以凝胶形式存在，水浴加热到70℃由凝胶转变为溶胶，温度在40～70℃保持溶胶状态，此时具有良好的流动性，可进入口内制取印模。掌握“暂时冠及印模与模型”知识点。